生物碱PKa值表示的是
A. 生物碱的熔点高低
B. 生物碱的溶解度大小
C. 生物碱的沸点高低
D. 生物碱的碱性强弱
E. 生物碱的折光率大小

正确答案：D。生物碱的碱性强弱

解析：本题考查生物碱的理化性质。生物碱pKa值表示的是生物碱的碱性强弱（D对）。生物碱碱性强度统一用其共轭酸的酸式离解常数pKa值表示。pKa越大，该碱的碱性越强；反之，碱性越弱。生物碱的溶解性（B错）与生物碱分子结构中氮原子的存在状态、分子大小、分子中极性基团的种类和数目以及溶剂的种类有关。